药物制成脂质体的目的是
A. 减小药物的扩散速度和减小药物的溶出速率，用药后能在较长时间内持续释放药物以达到延长药效的目的
B. 使释药速度接近零级速度过程，药物能在预定时间内自动以预定速度释放，血药浓度长时间恒定维持在有效浓度范围内
C. 缩短药物的生物半衰期
D. 降低药物的作用强度
E. 增强药物对靶组织的特异性，提高药物疗效，降低药物的毒副作用

正确答案：E。增强药物对靶组织的特异性，提高药物疗效，降低药物的毒副作用